正确描述甲状腺下动脉的是
A. 起自颈总动脉
B. 横过颈动脉鞘前面
C. 与甲状腺下静脉并行
D. 经过颈段气管的前面
E. 与喉返神经交叉

正确答案：E。与喉返神经交叉

解析：肩胛上动脉、甲状腺下动脉起自甲状颈干（A错）。甲状腺下动脉与喉返神经交叉（E对）。